疾病的三间分布是指
A. 国家、地区和城乡分布
B. 职业、家庭和环境分布
C. 短期波动、季节性和周期性分布
D. 年龄、性别和种族分布
E. 时间、地区和人群分布

正确答案：E。时间、地区和人群分布

解析：疾病的三间分布是指地区分布、时间分布、人群分布（E对）。国家、地区和城乡分布属于三间分布的地区分布（A错）。职业分布属于三间分布的人群分布，家庭和环境分布属于三间分布的地区分布（B错）。短期波动、季节性、周期性（C错）、长期变异分布属于三间分布的时间分布。年龄、性别、种族（D错）、职业、社会阶层、行为特征、婚姻状况、流动人口属于三间分布的人群分布。